围绕肛管的强大肌环，对肛管起括约作用的是
A. 肛直肠线
B. 肛皮线
C. Hilton线
D. 肛梳
E. 肛直肠环

正确答案：E。肛直肠环

解析：肛直肠环(E对)为围绕肛管的强大肌环，对肛管有重要的括约作用。肛直肠线(A错)连接各肛柱上端，肛皮线(B错)连接各肛柱下端与各肛瓣边缘，Hilton线(C错)为肛梳下缘的环形线，肛梳(D错)为齿状线下方的宽约1cm的环状区域。